易被溶酶菌杀死的细菌是
A. 大肠埃希菌
B. 淋球菌
C. 葡萄球菌
D. 沙门菌
E. 脑膜炎双球菌

正确答案：C。葡萄球菌

解析：本题考查易被溶酶菌杀死的细菌。易被溶酶菌杀死的细菌是葡萄球菌（C对）。大肠埃希菌（A错）、淋球菌（B错）、沙门菌（D错）、脑膜炎双球菌（E错）均属于革兰阴性菌，对溶菌酶不敏感。